女，30岁，妊娠18周。多汗心悸消瘦3个月，无其他不适，查：甲状腺Ⅱ度弥漫性肿大，T₃、T₄水平升高，TSH水平下降，诊断为甲状腺功能亢进。应首选的治疗药物
A. 丙硫氧嘧啶
B. 甲硫氧嘧啶
C. 他巴唑
D. 卡比马唑
E. 放射性碘剂

正确答案：C。他巴唑

解析：患者诊断为甲状腺功能亢进，妊娠18周，为妊娠T2期。如果妊娠Tl期确实需要抗甲状腺药物治疗，优先选择丙硫氧嘧啶（A错）。妊娠T2和T3期选择甲巯咪唑（他巴唑）（C对）。甲硫氧嘧啶效果不如丙硫氧嘧啶，故不作为首选药物（B错）。卡比马唑（D错）妊娠期使用有造成胎儿皮肤发育不良和胚胎病的可能，所以不作为首选药物。放射性碘剂（E错）会对胎儿生长发育有影响，因此禁忌用于妊娠妇女（P686）。